若测得某一级降解的药物在25℃时，K为0.02108/h，则其有效期为
A. 50h
B. 20h
C. 5h
D. 2h
E. 0.5h

正确答案：C。5h

解析：本题考查药品有效期。药品有效期是指该药品被批准使用的期限，表示该药品在规定的贮存条件下能够保证质量的期限。对于药物降解，常用降解10%所需的时间，称为十分之一衰期，记作t₀.₉，通常定义为有效期。其计算公式为：恒温时，t₀.₉=0.1054/k ，题中k=0.2108 代入公式可得t₀.₉=0.1054/0.02108；即，t₀.₉=5h（C对）。